68岁，胃部大手术，口腔黏膜刺激痛2月，双侧舌背黏膜片状充血，丝状乳头萎缩。可能诱因
A. 局部创伤
B. 内分泌
C. 病毒
D. 贫血营养
E. 局部过敏

正确答案：D。贫血营养

解析：本题考查地图舌的病因。地图舌的确切病因尚不明了，可能与下列因素有关：免疫因素、遗传因素、过敏体质、精神压力，吸烟、内分泌因素以及缺锌等（D对）。可伴发于其他疾病如沟纹舌、银屑病、糖尿病，胃肠紊乱灼口综合征或唐氏综合征等。